目前治疗三叉神经痛的首选药物是
A. 氯硝西泮
B. 苯妥英钠
C. 卡马西平
D. 山莨菪碱
E. 七叶莲

正确答案：C。卡马西平

解析：卡马西平：或称痛痉宁或酰胺咪嗪，是目前治疗三叉神经痛的首选药物。掌握“三叉神经痛”知识点。